位于后纵隔脊柱旁肋脊区内最常见的纵隔肿瘤是
A. 胸腺瘤
B. 心包囊肿
C. 畸胎瘤
D. 神经源性肿瘤
E. 淋巴瘤

正确答案：D。神经源性肿瘤

解析：后纵隔脊柱旁肋脊区内最常见的纵隔肿瘤是神经源性肿瘤（D对）。胸腺瘤（A错）多位于前上纵隔；心包囊肿位于中纵隔（B错）；畸胎瘤（C错）多位于前纵隔；淋巴瘤（E错）多位于后上纵隔，但无神经源性肿瘤多见。